出现下列哪种情况下，应注意给小儿及时断奶
A. 母亲患热病
B. 小儿患热病
C. 母乳充足
D. 母乳不足
E. 年龄已过1岁

正确答案：A。母亲患热病

解析：母亲患热病，多为感染性疾病，可使乳汁减少，甚至使乳汁带有细菌，哺乳会使小儿患病，同时影响母亲疾病的恢复，故母亲患热病时应注意给小儿及时断奶（A对）。避免在炎热的夏天和小儿患病时断奶，故小儿患热病（B错）时仍继续喂奶。母乳充足（C错）时应坚持母乳喂养，待婴儿长到8～12月时可以完全断奶。母乳不足（D错）时仍先哺母乳，待两侧乳房都已吸空，而不能满足婴儿需要时再添加牛乳或代乳品。年龄已过1岁（E错）时应逐渐断奶，减少哺乳次数，增加辅食。